抑制花生四烯酸代谢过程的环氧酶途径，造成白三烯增多而引发哮喘的是
A. 普萘洛尔
B. 阿司匹林
C. 毛果芸香碱
D. 利多卡因
E. 地塞米松

正确答案：B。阿司匹林

解析：本题考查解热镇痛药的作用机制。阿司匹林（B对）是环氧酶抑制药，能够发挥解热镇痛抗炎作用。